维生素E含量丰富的食品是
A. 蔬菜
B. 植物油
C. 水果
D. 肉类
E. 蛋类

正确答案：B。植物油